婴儿每日牛奶需要量个体差异较大，一般按每日能量和水的需要计算，婴儿每日能量需要量为100kcal（418.4kJ）/kg，每日水需要量为
A. 50ml/kg
B. 100ml/kg
C. 150ml/kg
D. 200ml/kg
E. 250ml/kg

正确答案：C。150ml/kg

解析：婴儿每日牛奶需要量个体差异较大，可根据具体情况增减。一般按每日能量和水的需要计算：婴儿每日能量需要量为100kcal（418.4kJ）/kg，每日水需要量为150ml/kg。掌握“婴儿喂养方法”知识点。